下列不属于公共卫生伦理原则框架的是
A. 公平原则
B. 为了公众的（集体）利益，同时兼顾个人利益的原则
C. 团结互助原则
D. 保密原则
E. 责任分担原则

正确答案：D。保密原则

解析：公共卫生伦理原则包括：①全社会参与原则；②社会公益原则；③社会公正原则；④互助协同原则；⑤信息公开原则。掌握“公共卫生伦理含义、理论基础与原则”知识点。